用雄激素治疗再生障碍性贫血，下列选项中，错误的是
A. 雄激素可刺激骨髓造血
B. 对慢性再障疗效较好
C. 对重型再障无效
D. 在用药一个月后无效
E. 目前常用的是司坦挫醇（康力龙）

正确答案：C。对重型再障无效

解析：再生障碍性贫血是一种可能由多种因素导致的骨髓造血功能衰竭症，表现为骨髓造血功能低下、全血细胞减少、贫血、感染、出血等。治疗上可选用雄激素通过刺激肾脏分泌红细胞生成素和直接刺激骨髓细胞的造血功能（A对），从而达到治疗贫血的目的，适用于全部再障患者（B对，C错，为本题正确答案）。雄激素治疗再生障碍性贫血，用药周期长，见效慢，一般需连续服用3-6个月才见效（D对）。临床常用的药物有司坦唑酮（E对）和达那唑等。